肿瘤手术中应严格遵守的“无瘤”原则是
A. 保证切除手术在正常组织内进行，避免切破肿瘤，防止挤压肿瘤，应整体切除，不宜分块挖出
B. 对肿瘤外露部分应以纱布覆盖，缝包，表面溃疡者电灼或化学药物处理
C. 缝合前应用大量低渗盐水及化学药物冲洗湿敷，缝合时应更换器械和手套
D. 术中和术后可静脉或区域性动脉内注射化疗药物
E. 以上原则均正确

正确答案：E。以上原则均正确

解析：本题考查肿瘤手术中应严格遵守的“无瘤”原则。口腔颌面部恶性肿瘤手术失败的主要原因为局部复发或远处转移，因此，在手术中应严格遵守“无瘤”操作。手术时，必须保证切除手术在正常组织内进行，避免切破肿瘤，防止挤压肿瘤，应整体切除，不宜分块挖出（A对）。对肿瘤外露部分应以纱布覆盖，缝包，表面溃疡者电灼或化学药物处理（B对）。为避免手术过程中污染种植，缝合前应用大量低渗盐水及化学药物冲洗湿敷，缝合时应更换器械和手套（C错）。术中和术后可静脉或区域性动脉内注射化疗药物（D错），以防止肿瘤的扩散。（ABCD均对，故E为本题的正确答案）。